治疗术后胀气宜选用的药品是
A. 新斯的明
B. 阿托品
C. 多巴胺
D. 异丙肾上腺素
E. 酚妥拉明

正确答案：A。新斯的明

解析：本题考查新斯的明的临床应用。新斯的明（A对）具有抗胆碱酯酶作用，多用于重症肌无力及腹部手术后的肠麻痹、以及术后胀气的治疗。